属于稳定性高温试验条件的是
A. 在60℃温度下放置10天
B. 在25℃和相对湿度（90±5）%条件下放置10天
C. 在65℃温度下放置10天
D. 在（4500±500）Lx的条件下放置10天
E. 在（8000±800）Lx的条件下放置10天

正确答案：A。在60℃温度下放置10天

解析：本题考查药物稳定性试验方法。影响因素试验一般包括高温、高湿、光照试验。高温试验：供试品置密封的洁净容器中，在60℃条件下放置10天（A对C错），分别于第5天和第10天取样，检测有关指标。高湿试验：供试品置恒湿密闭的容器中，于25℃、相对湿度90±5%条件下放置10天（B错），分别在第5天和第10天取样检测。强光照射试验：供试品开口放在装有日光灯的光照箱或其他适宜的光照装置内，于照度为4500lx±500lx的条件下放置10天（D错），分别于第5天和第10天取样，按稳定性重点考查项目进行检测。